不属于副交感核的脑神经核是
A. 上泌涎核
B. 下泌涎核
C. 疑核
D. 迷走神经背核
E. 动眼神经副核

正确答案：C。疑核

解析：含副交感核的脑神经核包括动眼神经副核（E对）、上泌涎核（A对）、下泌涎核（B对）和迷走神经背核（D对）。疑核（C错，为本题正确选项）属于特殊内脏运动核。